性别比例指
A. 女性与男性人口数之比
B. 女性与男性人口数之百分比
C. 女性与男性人口数之千分比
D. 男性与女性人口数之比
E. 男性与女性人口数之千分比

正确答案：D。男性与女性人口数之比